某患者有丛林接触史，突发高热，用变形杆菌OX19与患者血清进行外斐反应，抗体效价为1∶320，该患者可能的印象诊断是
A. 流行性乙型脑炎
B. 肠伤寒
C. 森林脑炎
D. 恙虫病
E. 斑疹伤寒

正确答案：E。斑疹伤寒